针对乳腺癌冲任失调证者，宜用
A. 逍遥散加减
B. 二仙汤加味
C. 清瘟败毒饮合桃红四物汤加减
D. 人参养荣汤加减
E. 失笑散合开郁散加减

正确答案：B。二仙汤加味

解析：乳腺癌冲任失调证，表现为经事紊乱，素有经前期乳房胀痛，或婚后从未生育，或有多次流产史，乳房结块坚硬；舌淡，苔薄，脉弦细。治法：调摄冲任，理气散结。方药：二仙汤合开郁散加减（B对）。乳核肝气郁结证，治法：疏肝解郁，化痰散结，方药：逍遥散加减（A错）。热毒蕴结证，用清瘟败毒饮具有气血两清，清热解毒，凉血泻火之功效。主治温疫热毒，气血两燔证。桃红四物汤功效：养血活血，主治：血虚兼血瘀证（C错）。乳腺癌气血两亏证，治法：补益气血，养心安神。方药：人参养荣汤加减（D错）。乳腺癌肝郁痰凝证，治法：疏肝解郁、化痰散结。方药：失笑散合开郁散加减（E错）。